药剂学的主要研究内容不包括
A. 新辅料的研究与开发
B. 制剂新机械和新设备的研究与开发
C. 新药申报法规及药学信息学的研究
D. 新剂型的研究与开发
E. 医药新技术的研究与开发

正确答案：C。新药申报法规及药学信息学的研究

解析：本题考查药剂学的研究任务。药剂学的主要研究内容包括：基本理论的研究，新剂型的研究与开发，新辅料的研究与开发，制剂新机械和新设备的研究与开发，中药新剂型的研究与开发，生物技术药物制剂的研究与开发，医药新技术的研究与开发。不包括新药申报法规及药学信息学的研究（C错，为本题正确答案）。